男，40岁。1小时前游泳时溺水送来急诊。查体：P120次/分，R34次/分，BP90/60mmHg，神志尚清，烦躁不安，口唇发绀，双肺可闻及广泛湿性啰音，动脉血气分析（FiO₂=50%）;pH7.52，PaCO₂30mmHg，PaO₂60mmHg。该患者出现严重呼吸衰竭最主要的原因是
A. 肺泡通气量下降
B. 弥散功能障碍
C. 呼吸中枢活动减弱
D. 肺内分流显著增加
E. 通气/血流比例失调

正确答案：D。肺内分流显著增加

解析：患者中年男性，溺水送来急诊。查体：P120次/分（正常值60～100次/分），R34次/分（正常12～20次/分），BP90/60mmHg（正常值90～120/60～90mmHg），神志尚清，烦躁不安，口唇发绀（缺氧表现），双肺可闻及广泛湿性啰音，动脉血气分析（FiO₂=50%）；pH7.52，PaCO₂30mmHg（正常值35～45mmHg），PaO₂60mmHg（正常值＞95mmHg）。PaO₂/FiO₂ 正常值为 400 - 500mmHg， ≤300mmHg 是诊断 ARDS 的必要条件。该患者PaO₂/FiO₂ =120mmHg，可诊断为急性呼吸窘迫综合征（ARDS）。其病理和肺形态改变可引起肺顺应性降低、肺内分流增加（D对），造成顽固性低氧血症和呼吸窘迫。虽然ARDS 也可引起肺泡弥散功能障碍、通气／血流比例失调，但不是导致ARDS 的最重要原因（BE错）。肺泡通气量下降是II 型呼吸衰竭的主要原因（A错），该患者PaCO₂30mmHg，PaO₂60mmHg为I 型呼吸衰竭。ARDS 早期，呼吸中枢活动加强，可导致呼吸加深加快（C错） 。